营养素的最高摄入量说法正确的是
A. 平均每日机体合成能量的需要值
B. 平均每日机体蛋白质的需要值
C. 平均每日机体消耗营养素的值
D. 平均每日营养素的最髙需要值
E. 平均每日可以摄入某营养素可耐受最高摄入量

正确答案：E。平均每日可以摄入某营养素可耐受最高摄入量

解析：营养素的最高摄入量，又称可耐受最高摄入量，是指平均每日可以摄入某种营养素的最高量（E对）。这个量对一般人群中的几乎所有个体都不至于损害健康。